药用部分不是根茎的生药是
A. 天南星
B. 泽泻
C. 麦冬
D. 山药
E. 知母

正确答案：C。麦冬

解析：本题考查的是麦冬的来源。药用部分不是根茎的生药是麦冬（C错，为本题正确答案）。麦冬：【来源】为百合科植物麦冬的干燥块根。天南星（A对）：【来源】为天南星科植物天南星、异叶天南星或东北天南星的干燥块茎。泽泻（B对）：【来源】为泽泻科植物泽泻的干燥块茎。山药（D对）：【来源】为薯蓣科植物薯蓣的干燥根茎。知母（E对）：【来源】为百合科植物知母的干燥根茎。